胎传梅毒又叫
A. 获得性梅毒
B. 后天梅毒
C. 先天性梅毒
D. 早期梅毒
E. 晚期梅毒

正确答案：C。先天性梅毒